从病原体侵入机体到临床症状出现这段时间为
A. 病原侵入期
B. 前驱期
C. 潜伏期
D. 传染期
E. 无症状期

正确答案：C。潜伏期